女，60岁。性交接触性出血4月余，妇科检查：外阴阴道未见异常，宫颈肥大糜烂质脆，子宫及双附件未见异常。病理检查报告宫颈鳞状细胞异型性增生，占宫颈上皮全层2/3以上，伴人乳头瘤病毒感染，此例应诊断为
A. CINⅠ
B. CINⅡ
C. CINⅢ
D. 宫颈糜烂
E. 宫颈癌

正确答案：C。CINⅢ

解析：患者为老年女性，接触性出血数月余，妇检：外阴阴道未见异常，宫颈肥大糜烂质脆，子宫及双附件未见异常。病理检查报告宫颈鱗状细胞异型性增生，占宫颈上皮全层2/3以上，伴人乳头瘤病毒感染，应诊断为CINⅢ（C对）。CIN分3级：Ⅰ级：即轻度异型。异型细胞局限于上皮下1/3。Ⅱ级：即中度异型。异型细胞累及上皮下1/3～2/3。Ⅲ级：包括重度异型和原位癌。病变细胞占据2/3层以上或全部上皮层。宫颈糜烂（P255）（D错）属于慢性子宫颈炎，是子宫颈间质内的炎细胞浸润，与细胞异型性无关。宫颈癌（P298）（E错）是CIN继续发展，异型细胞突破基底膜，浸润间质。。